分布至瞳孔开大肌的神经是
A. 展神经
B. 交感神经
C. 滑车神经
D. 动眼神经
E. 视神经

正确答案：B。交感神经

解析：分布至瞳孔开大肌的神经是交感神经（B对）。